以下关于平滑面牙釉质龋镜下所见不正确的是
A. 最早显示釉质横纹和生长线明显
B. 釉质龋继续发展后，深层受累，病损呈倒三角形
C. 三角形的顶部向着釉牙本质界
D. 三角形的基底部向着牙釉质牙本质界
E. 三角形顶部为病变最早、最活跃的部分

正确答案：D。三角形的基底部向着牙釉质牙本质界

解析：本题考查牙釉质龋。以下关于平滑面牙釉质龋镜下所见不正确的是三角形的基底部向着牙釉质牙本质界（D错，为本题正确答案）。光镜下观察釉质早期平滑面龋纵磨片，最早显示为病损区的釉柱横纹和生长线变得明显，以后逐渐有色素沉着。当釉质龋继续发展，釉质深层受累，病损呈倒三角形，三角形的顶部向着釉牙本质界，基底部向着釉质表面，三角形顶部为病变最早、最活跃的部分。病变的此种形态与釉柱从釉牙本质界向表面呈放射状排列有关。